劳动条件的组成中不包括
A. 生产工艺过程
B. 生产环境
C. 健康监护
D. 劳动组织
E. 操作体位和方式

正确答案：C。健康监护